在体内可发生去甲基化代谢，其代谢产物仍具有活性抗抑郁的药物有
A. 氟西汀
B. 舍曲林
C. 文拉法辛
D. 艾司西酞普兰
E. 阿米替林

正确答案：A、B、C、E。氟西汀；舍曲林；文拉法辛；阿米替林

解析：本题考查抗抑郁药。在体内可发生去甲基化代谢，其代谢产物仍具有活性抗抑郁的药物有氟西汀（A对）、舍曲林（B对）、文拉法辛（C对）、阿米替林（E对）。常用的抗抑郁药有去甲肾上腺素再摄取抑制剂及5-羟色胺再摄取抑制剂等。阿米替林是去甲肾上腺素再摄取抑制剂中的一种，氟西汀、文法拉辛和舍曲林均属于5-羟色胺再摄取抑制剂，它们的结构中均含有甲基，在体内发生脱甲基代谢后分别产生去甲替林、去甲氟西汀、O-去甲文拉法辛和N-去甲舍曲林，这些产物仍具有抗抑郁活性。西酞普兰（D错）在肝脏中CYP2C19，CYP2D6和CYP3A4等酶的作用下生成N-去甲基西酞普兰，艾司西酞普兰是西酞普兰的S对映体。